舌下腺囊肿治疗中错误的是
A. 摘除舌下腺
B. 口外型需从口外入路
C. 口外型术后需加压包扎
D. 囊壁可不摘除
E. 舌下腺摘除后需放引流物

正确答案：B。口外型需从口外入路

解析：本题考查舌下腺囊肿的治疗。舌下腺囊肿治疗中错误的是口外型需从口外入路（B错，为本题的正确答案）。舌下腺囊肿临床上可分为三型：单纯型、口外型和哑铃型。口外型主要表现为下颌下区肿物，而口底囊肿表现不明显，根治舌下腺囊肿的方法是摘除舌下腺（A对）。对于口外型的囊肿可从口外入路也可从口内入路，口内切口面部无疤痕，不影响美观，尤其适合年轻人及对美观标准要求高的人群，但若处理不当容易复发，必要时可配合颌下切口引流，以求彻底治愈病变；从口外入路留有疤痕，影响美观，存在损伤面神经下颌缘支的可能，现已少用。口外型囊肿可将囊腔内的囊液吸净以后在下颌下区加压包扎（C对），以促进创口愈合。舌下腺囊肿的囊壁可不摘除（D对），残留部分囊壁不致造成复发。为预防血肿，舌下腺摘除后需放引流物（E对），应将其缝合固定，以免进入创口内，术后1～2d抽取引流条，7d拆线。